关于注射剂特点的说法，错误的是
A. 药效迅速
B. 剂量准确
C. 使用方便
D. 作用可靠
E. 适用于不宜口服的药物

正确答案：C。使用方便

解析：本题考查注射剂的特点。注射剂的特点：(1)药效迅速（A对）、剂量准确（B对）、作用可靠（D对）。(2)可适用于不宜口服给药的患者和不宜口服的药物（E对）。(3)可发挥局部定位作用，但注射给药不方便（C错，为本题正确答案），注射时易引起疼痛。(4)易发生交叉污染，安全性不及口服制剂。(5)制造过程复杂，对生产的环境及设备要求高，生产费用较大，价格较高。